属于异丙肾上腺素α-受体阻断剂，可改善尿道梗阻症状的药品
A. 黄酮哌酯
B. 氟他胺
C. 特拉唑嗪
D. 非那雄胺
E. 尼尔雌醇

正确答案：C。特拉唑嗪

解析：本题考查抗前列腺增生药。异丙肾上腺素α-受体阻断剂如特拉唑嗪（C对），通过抑制前列腺和膀胱颈部平滑肌表面的肾上腺素能受体，减轻前列腺张力和膀胱出口梗阻，达到可改善尿道梗阻症状的目的。黄酮哌酯（A错）是植物提取成分的抗前列腺增生药。氟他胺（B错）属于雄激素受体阻断剂。非那雄胺（D错）是5α-还原酶抑制剂，可诱导前列腺上皮细胞的凋亡，抑制前列腺生长。尼尔雌醇（E错）是口服长效雌激素，应用于雌激素缺乏引起的绝经期或更年期综合征。